外源化合物的联合作用类型有
A. 相加作用
B. 协同作用
C. 拮抗作用
D. 以上都是

正确答案：D。以上都是

解析：本题考查外源化合物的联合作用类型。联合作用指两种或两种以上的化学物同时或先后作用于生物体所引起的毒作用。其类型有：相加作用、独立作用、协同作用和拮抗作用（D对ABC错）。